女，45岁，2型糖尿病2年。用二甲双胍0.25g，每日3次。空腹血糖6.2mmol/L，餐后2小时血糖12.6mmol/L。近2个月发热、咳嗽，痰结核菌阳性。控制血糖应给予
A. 加大二甲双胍剂量
B. 磺脲类口服降糖药
C. 胰岛素
D. 葡萄糖苷酶抑制剂
E. 胰岛素增敏剂

正确答案：C。胰岛素